上皮浅层破坏，未侵犯上皮全层，称为
A. 棘层内疱
B. 基层下疱
C. 角化不良
D. 异常增生
E. 糜烂

正确答案：E。糜烂

解析：上皮浅层破坏，未侵犯上皮全层叫糜烂。掌握“口腔黏膜基本病理变化”知识点。